不属于第一心音特点的是
A. 音调低，强度较响
B. 声音时限较长
C. 心尖搏动之后出现
D. 心尖部最响
E. 第一心音和第二心音间隔较短

正确答案：C。心尖搏动之后出现

解析：第一心音（八版生理学P90）是由于房室瓣突然关闭引起心室内血液和室壁的振动，以及心室射血引起的大血管壁和血液湍流所发生的振动而产生的。其听诊特点为音调低，强度较响（A对），声音时限较长（B对），与心尖搏动同时出现（C错，为本题正确答案），在心尖部最响（D对），第一心音和第二心音间隔较短（E对）。